下列各项，不属于缺铁性贫血中医证型的是
A. 脾胃虚弱
B. 心脾两虚
C. 肝肾阴虚
D. 脾肾阳虚
E. 虫积

正确答案：C。肝肾阴虚

解析：缺铁性贫血的中医证型有脾胃虚弱（A对）、心脾两虚（B对）、脾肾阳虚（D对）、虫积（E对）等，本病病位在脾胃，与肝、肾相关，脾胃虚弱，运化失常，虫积及失血导致气血生化不足，是本病发生的基本病机。肝肾阴虚（C错，为本题正确答案）不属于缺铁性贫血中医证型。